标准正态分布的两个参数值分别是
A. u=0，σ=0
B. u=1，σ=0
C. u=1，σ=-1
D. u=-1，σ=1
E. u=0，σ=1

正确答案：E。u=0，σ=1

解析：μ（均数）和σ（标准差）为正态分布的两个参数，标准正态分布的两个参数值分别是μ=0，σ=1（E对）。任意一个服从N（μ，σ²）分布的随机变量X，经变化都可转换为μ=0和σ=1的标准正态分布。